具有攻毒杀虫祛痰平喘功效的药物是
A. 砒石
B. 炉甘石
C. 硫黄
D. 硼砂
E. 莲子

正确答案：A。砒石

解析：砒石外用有攻毒杀虫，蚀疮去腐的功效；又因本品味辛性大热，入肺经，内服能祛寒劫痰平喘（A对）。炉甘石的功效为解毒明目退翳，收湿止痒敛疮（B错）。硫黄的功效为外用解毒疗疮、杀虫止痒；内服补火助阳通便（C错）。硼砂的功效为外用清热解毒，内服清肺化痰（D错）。莲子的功效为补脾止泻，止带，益肾涩精，养心安神（E错）。